下列关于缺铁性贫血检验结果的描述，正确的是
A. 血清总铁结合力增高
B. 血清铁浓度增高
C. 转铁蛋白饱和度增高
D. 血清铁蛋白增高
E. 铁粒幼红细胞增多

正确答案：A。血清总铁结合力增高

解析：缺铁性贫血铁代谢情况：血清总铁结合力增高（A对）、血清铁浓度降低（B错）、转铁蛋白饱和度降低（C错）、血清铁蛋白降低（D错）、铁粒幼红细胞减少（E错）。